患者，女，40岁。3年前发现患有风湿性心脏病，近半年来，体力活动明显受限，轻度活动即出现心悸，气短。其心功能为
A. I级
B. Ⅱ级
C. Ⅲ级
D. Ⅳ级
E. 以上均非

正确答案：C。Ⅲ级

解析：患者体力活动明显受限，轻度活动即出现心悸，气短，故患者心功能为Ⅲ级（C对）。心功能分级：（1）Ⅰ级：心脏病患者日常活动量不受限制，一般活动不引起乏力、呼吸困难等心衰症状。（2）Ⅱ级：心脏病患者体力活动轻度受限，休息时无自觉症状，一般活动下可出现心衰症状。（3）Ⅲ级：心脏病患者体力活动明显受限，低于平时一般活动即可引起心衰症状。（4）Ⅳ级：心脏病患者不能从事任何体力活动，休息状态下也存在心衰症状，活动后加重。